成组设计多个样本比较秩和检验的近似检验为
A. F检验
B. t检验
C. χ²检验
D. 拟合优度检验
E. u检验

正确答案：C。χ²检验